胃动脉的分布中，错误的是
A. 胃底-胃短动脉
B. 胃大弯-胃网膜左、右动脉
C. 胃小弯-胃左、右动脉
D. 胃后壁-胃后动脉
E. 胃前壁-胃前动脉

正确答案：D。胃后壁-胃后动脉

解析：胃短动脉分布于胃底（A对）。胃网膜左、右动脉在胃大弯处吻合（B对）。胃左、右动脉在胃小弯处吻合（C对）。胃后动脉分布于胃底（D错，为本题正确答案）。胃前动脉分布于胃前壁（E对）。